网膜囊的左侧为
A. 肝尾叶和膈下方腹膜
B. 肝下方和膈下方腹膜
C. 脾胃韧带和脾肾韧带
D. 脾膈韧带和脾肾韧带
E. 藉网膜孔通腹膜腔的其它部分

正确答案：C。脾胃韧带和脾肾韧带

解析：肝尾状叶和膈下方的腹膜（AB错）为网膜囊的上壁，脾胃韧带和脾肾韧带（C对）为网膜囊的左侧，右侧借网膜孔通腹膜腔的其它部分（E错）。脾膈韧带和脾肾韧带（D错）与网膜囊无关。